吸入性肺脓肿最常见的病原体是
A. 铜绿假单胞菌
B. 厌氧菌
C. 表皮金黄色葡萄球菌
D. 金黄色葡萄球菌
E. 肺炎链球菌

正确答案：B。厌氧菌

解析：吸入性肺脓肿，是肺脓肿最常见的一种类型。当昏迷、醉酒、药物过量、癫痫、脑血管意外时，或由于受寒、极度疲劳等诱因，全身免疫力与呼吸道防御功能降低，误吸入含病原菌的各种污染物而致病，如口咽分泌物等，其中厌氧菌占90%以上（B对）。某些细菌性肺炎，如金黄色葡萄球菌（D错）、铜绿假单胞菌（A错）和肺炎克雷伯杆菌肺炎等继发性感染可导致继发性肺脓肿。血源性肺脓肿致病菌以金黄色葡萄球菌（D错）、表皮葡萄球菌（C错）及链球菌（E错）为常见。